成年典型缺铁性贫血，下列血象结果中不支持的是
A. WBC18×10⁹/L
B. MCV76fl
C. 网织红细胞0.02
D. MCHC 28%
E. Plt350×10⁹/L

正确答案：A。WBC18×10⁹/L

解析：缺铁性贫血时，血象呈小细胞低色素性贫血，平均红细胞体积（MCV）低于80fl（B对），平均红细胞血红蛋白量（MCH）小于27pg，平均红细胞血红蛋白浓度（MCHC）小于32％（D对）；网织红细胞正常或轻度增高（正常值0.005～0.015）（C对）；白细胞（正常值4～10×10⁹/L）和血小板（正常值100～300×10⁹/L）正常或减少，部分患者血小板可升高（E对），白细胞＞10×10⁹/L（A错，为本题正确答案）常见于细菌感染。